患者因上前牙充填体脱落就诊。洞深达牙本质深层，一次完成充填治疗。充填后3天出现自发痛，不敢咬合。查：左上1远中面充填体，叩（++），松动Ⅰ度，牙龈轻度红肿，冷热测无反应，该患牙3天前处理中的问题最可能是
A. 诊断失误
B. 充填材料选择不当
C. 充填时未垫底
D. 洞形制备不当
E. 腐质未去尽

正确答案：A。诊断失误

解析：本题考查充填后疼痛-自发痛。该患牙3天前处理中的问题最可能是诊断失误（A对）。根据病例描述，患者充填后3天出现自发痛，不敢咬合，考虑患牙曾有不可复性牙髓炎；左上1远中面充填体，叩（++），松动Ⅰ度，牙龈轻度红肿，冷热测无反应，考虑左上1目前为急性根尖周炎；患者3天前洞深达牙本质深层，一次完成充填治疗，考虑3天前可能有小的穿髓孔没有发现，牙髓已部分感染，但症状不明显，可能误判为可复性牙髓炎，患牙3天前处理中的问题最可能是诊断失误。充填材料选择不当，主要表现为充填材料对牙髓的慢性刺激而导致的远期疼痛不适（B错）。充填时未垫底，冷热刺激可通过充填材料刺激牙髓，引起激发痛，但不会出现自发痛（C错）。洞形制备不当可使充填体发生折断或脱落，短期内不会引起牙髓炎症（D错）。腐质未去尽会导致病变继续发展，累及牙髓，出现远期的疼痛，不会在3天就出现明显的牙髓炎症症状（E错）。